甲状腺功能亢进症行甲状腺次全切除术后出现呼吸困难最常见的原因是
A. 伤口血肿
B. 甲状腺危象
C. 双侧喉上神经损伤
D. 甲状腺功能低下
E. 气管塌陷

正确答案：A。伤口血肿

解析：甲状腺功能亢进症术后出现呼吸困难常见的原因有：出血及血肿压迫气管（A对）、喉头水肿、气管塌陷、双侧喉返神经损伤，其中伤口血肿最常见。甲状腺危象（B错）是甲亢术后的严重并发症，主要表现为高热，脉快，神经、循环及消化系统的功能紊乱等（P230）；双侧喉上神经损伤（C错）表现为环甲肌瘫痪、音调变低、呛咳等（P229）；甲状腺功能低下（D错）是甲状腺功能亢进症的术后并发症，但不会导致呼吸困难；气管塌陷（E错）也是甲亢术后呼吸困难的常见原因，但并非最常见原因。